蒲黄不具有的药理作用是
A. 止血
B. 降血压
C. 兴奋子宫
D. 抗心律失常
E. 抗心肌缺血

正确答案：D。抗心律失常